男孩，8岁。上课反应迟钝，一般学习任务难以完成，家长带其心理门诊就诊。此时，心理治疗师应该首先考虑使用的心理评估工具是
A. WISC
B. SDS
C. 16PF
D. EPQ
E. SAS

正确答案：A。WISC

解析：8岁男孩学习成绩不好，首先应评估该男孩的智力是否正常，8岁男童多采用韦克斯勒儿童智力量表（WISC）适用于6-16岁。SDS（抑郁自评量表）主要评估患者的抑郁严重程度。16PF（卡特尔16项人格问卷）、EPQ（艾森克人格问卷）主要用于人格测验。SAS（焦虑自评量表）主要用于评估焦虑严重程度。掌握“常用的心理测验及临床评定测量表”知识点。